口腔念珠菌病的主要病理特征是
A. 上皮变性坏死
B. 上皮内念珠菌的菌丝
C. 上皮内微小脓肿
D. 上皮内念珠菌的白色斑膜
E. 上皮角化层水肿

正确答案：B。上皮内念珠菌的菌丝

解析：病理变化：黏膜病变一般为亚急性或慢性炎症。念珠菌侵入组织，引起上皮表层水肿，角化层内有中性粒细胞浸润，常形成微小脓肿。上皮棘层增生，上皮钉突呈圆形，基底膜部分被炎症破坏。在角化层或上皮的外1/3处可见菌丝，菌丝与上皮表面多呈垂直型或呈一定角度，HE染色不甚清晰，PAS染色为强阳性。结缔组织中有充血的毛细血管及大量淋巴细胞、浆细胞和中性粒细胞浸润。急性假膜性念珠菌病的白色假膜在镜下为上皮变性坏死，并有大量念珠菌的菌丝和孢子。病变处可作涂片检查，方法为轻轻刮白色斑膜的表层，放置于清洁的载玻片上，滴加10%～15%氢氧化钾（或氢氧化钠）溶液，再加盖玻片，放于光学显微镜下观察菌丝及孢子。掌握“口腔念珠菌病与肉芽肿性唇炎”知识点。